桑菊饮适用于哪种证型的急性支气管炎引起的咳嗽
A. 痰湿
B. 阴虚
C. 风热
D. 痰热
E. 风寒

正确答案：C。风热

解析：桑菊饮的功效是疏风清热，宣肺止咳，治疗风热犯肺引起的急性支气管炎引起的咳嗽（C对）。急性支气管炎引起的咳嗽没有痰湿（A错）、阴虚（B错）、痰热（D错）证型。风寒（E错）袭肺证的治法是疏风散寒，宣肺止咳，方药为三拗汤合止嗽散加减。